舌的淋巴管与颈深上淋巴结的关系是
A. 愈近舌尖而起的淋巴管，其注入的颈深上淋巴结所在的部位愈低
B. 愈近舌尖而起的淋巴管，其注入的颈深上淋巴结所在的部位愈高
C. 愈近舌根部而起的淋巴管，其注入的颈深上淋巴结所在部位愈高
D. 愈近舌根部而起的淋巴管，其注入的颈深上淋巴结所在部位愈低
E. A+C

正确答案：E。A+C

解析：舌的淋巴管极为丰富，最终汇入在二腹肌后腹与肩胛舌骨肌之间沿颈内静脉排列的颈深上淋巴结。舌的淋巴回流特点：愈近舌尖而起的淋巴管，其注入的颈深上淋巴结所在的部位愈低；愈近舌根部而起的淋巴管，其注入的颈深上淋巴结所在部位愈高。掌握“腭、舌、舌下区的局部解剖”知识点。